一般在24小时内引流量少于20～30ml时去除引流物
A. 负压引流
B. 油纱条引流
C. 片状引流
D. 管状引流
E. 碘仿纱条引流

正确答案：A。负压引流

解析：负压引流一般在24小时内引流量少于20～30ml时去除。掌握“口外手术打结、缝合及外科引流”知识点。